休克早期（缺血期）可出现
A. 微循环少灌少流，灌少于流
B. 微循环少灌多流，灌多于流
C. 微循环多灌少流，灌多于流
D. 微循环多灌多流，灌多于流
E. 微循环多灌多流，灌少于流

正确答案：A。微循环少灌少流，灌少于流

解析：少灌少流，灌少于流（A对BCDE错），组织呈缺血缺氧状态是休克早期（缺血期）组织微循环灌流的特点。